对医师的业务水平工作成绩和职业道德状况，依法享有定期考核权的单位是
A. 县级以上人民政府
B. 县级以上人民政府卫生行政部门
C. 受县级以上人民政府卫生行政部门委托的机构或者组织
D. 医师所在地的医学会或者医师协会
E. 医师所工作的医疗预防保健机构

正确答案：C。受县级以上人民政府卫生行政部门委托的机构或者组织

解析：《执业医师法》规定，县级以上人民政府卫生行政部门负责指导、检查和监督医师考核工作。根据卫生部《医师定期考核管理办法》，受县级以上人民政府卫生行政部门委托的机构或者组织（C对），应当按照医师执业标准，对医师的业务水平、工作成绩和职业道德状况进行定期考核。